主要作为助流剂使用，可将颗粒表面的凹陷填满补平改善颗粒流动性的辅料是
A. 滑石粉
B. 硬脂酸镁
C. 氢化植物油
D. 聚乙二醇类
E. 微粉硅胶

正确答案：A。滑石粉